妊娠期妇女服用抗癫痫药卡马西平可导致缺乏的维生素是
A. 维生素E
B. 维生素K
C. 维生素D
D. 维生素C
E. 维生素A

正确答案：B。维生素K

解析：本题考查妊娠期妇女服用抗癫痫药卡马西平可导致维生素K（B对）缺乏，妊娠期妇女在妊娠期最后1个月应补充口服维生素K，以免引起新生儿出血。